Ⅰ型超敏反应的发生机制是指
A. 致敏
B. 激发
C. 预贮备介质
D. 新合成的介质
E. 以上说法均正确

正确答案：E。以上说法均正确

解析：1)致敏：进入机体的变应原刺激B细胞产生的特异性IgE抗体。该IgE抗体以其Fc段与肥大细胞或嗜碱性粒细胞表面的FcεRⅠ结合，这种结合累积到一定程度，机体就进入了致敏状态。致敏状态可维持数月甚至更长。2)激发：相同的变应原再次进入机体后与致敏的肥大细胞或嗜碱性粒细胞表面的IgE结合、交联使其脱颗粒、释放生物学活性介质。3)效应：释放的生物活性介质作用于效应器官，引起局部或全身性过敏反应。生物活性介质主要有以下两类：（1）预贮备介质。（2）新合成的介质。掌握“概述及Ⅰ型超敏反应”知识点。